病员患胆管癌，术中术者用手指钝性剥离胆总管而撕破静脉急性大出血，慌乱中用钳夹止血，造成静脉完全离断，虽经吻合，病员终因急性肝功能衰竭而死亡。产生的后果属于
A. 医疗意外
B. 医疗差错
C. 病情重笃而发生的难以避免的死亡
D. 医疗事故
E. 手术难以避免的并发症

正确答案：D。医疗事故

解析：医疗事故的定义：本条例所称医疗事故，是指医疗机构及其医务人员在医疗活动中，违反医疗卫生管理法律、行政法规、部门规章和诊疗护理规范、常规，过失造成患者人身损害的事故。本例存在过失。掌握“医疗事故行政处理、监督与法律责任”知识点。